下列溃疡中有复发性的是
A. 重型阿弗他溃疡
B. 癌性溃疡
C. 结核性溃疡
D. 创伤性溃疡
E. 坏死性涎腺化生

正确答案：A。重型阿弗他溃疡

解析：本题考查具有复发性的溃疡。重型阿弗他溃疡（A对）是复发性阿弗他溃疡的一种类型，具有周期性、复发性、自限性的特征，具有“黄、红、凹、痛”的临床特征。癌性溃疡（B错）深大，底部有菜花状细小颗粒突起，边缘隆起翻卷，扪诊有基底硬结，疼痛不明显，无复发性。结核性溃疡（C错）无复发史而又长期不愈。创伤性溃疡（D错）去除刺激因素后，溃疡很快明显好转或愈合，无复发史。坏死性涎腺化生（E错）有自愈性，愈合后不复发。